高血钾症是指，血钾浓度高于
A. 3.5mmol/L
B. 4mmol/L
C. 4.5mmol/L
D. 5mmol/L
E. 5.5mmol/L

正确答案：E。5.5mmol/L

解析：血清钾浓度＞5.5mmol/L称高钾血症（E对）。